主含挥发油及树脂的药材是
A. 木通
B. 沉香
C. 大血藤
D. 钩藤
E. 鸡血藤

正确答案：B。沉香

解析：本题考查的是沉香的化学成分。主含挥发油及树脂的药材是沉香（B对）。沉香有树脂及挥发油而有特殊香气。钩藤（D错）含钩藤碱和异钩藤碱，属于生物碱，加热易被破坏。木通（A错）、大血藤（C错）与鸡血藤（E错）的化学成分，2022年考试指南未明确说明。